女，30岁，月经不规律3年，闭经7个月，溢乳2个月。对诊断最有价值的测定项目是
A. 促甲状腺激素
B. 泌乳素
C. 孕激素
D. 雄激素
E. 雌激素

正确答案：B。泌乳素

解析：女，30岁，月经不规律3年（月经紊乱），闭经7个月，溢乳2个月（高催乳素血症的典型临床表现：闭经泌乳综合征）。根据患者的临床表现，诊断考虑高催乳素血症。泌乳素（也叫催乳素）测定（B对）是高催乳素血症的确诊方法，对诊断高催乳素血症的价值最高。促甲状腺激素（A错）（八版内科P688）是反映甲状腺功能最敏感的指标。孕激素（C错）（P424）对于原发性或继发性闭经、无排卵性月经、无排卵性功能失调性子宫出血、多囊卵巢综合症、异位妊娠、先兆流产等有诊断价值。雄激素（D错）（P425）对于卵巢男性化肿瘤、多囊卵巢综合症、肾上腺皮质增生或肿瘤、两性畸形、女性多毛症等有诊断价值。雌激素（E错）（P423）对于闭经原因、有无排卵、女性性早熟、胎盘功能是否正常等有诊断价值，还可协助诊断多囊卵巢综合症。